男性，25岁。间断左耳流脓5个月，两个月来左外耳道干燥。近一个月来出现持续性头痛，体温38℃左右。入院前两周头痛加重，伴呕吐。三小时前呼之不应，急诊入院。入院查体，中度昏迷，瞳孔左：右＝4：2，对光反应消失，右侧肢体力弱，以上肢为著，右侧霍夫曼氏征（+）。紧急处理措施首先是
A. 止吐
B. 抗感染
C. 静脉输入甘露醇
D. 静脉输入抗癫痫药物
E. 静脉输入地塞米松

正确答案：C。静脉输入甘露醇

解析：青年患者，间断左耳流脓5个月，两个月来左外耳道干燥（提示患者有慢性中耳炎），近一个月来出现持续性头痛，体温38℃左右，入院前两周头痛加重，伴呕吐，提示患者有明显的颅内压增高症状，且已经表现出呼之不应、中度昏迷，左侧瞳孔散大，对光反应消失（左侧动眼神经麻痹），右侧肢体力弱，上肢为著，右侧霍夫曼氏征（+）等脑干受压的症状。考虑已有脑疝形成。脑疝是颅内压增高的严重后果，易危及生命，因此，患者紧急处理措施首先是静脉输入甘露醇（C对）快速降低颅内压。患者呕吐是因颅内压增高所致，若颅内压下降，患者便会停止呕吐，无需止吐（A错）。该患者考虑为慢性中耳炎所致的脑脓肿并发脑疝形成，此时应处理对患者生命有威胁的脑疝，抗感染（B错）是对因治疗，不是此时应采取的紧急措施。静脉输入地塞米松（E错）也可以降低颅内压，但效果不如甘露醇明显，同时输地塞米松还可以退烧、抗炎，起到保护脑功能的作用。抗癫痫药物（D错）用于癫痫发作患者，本例患者无癫痫症状。